缺损多发生在牙唇面、颊面的牙颈部其病多为
A. 龋病
B. 外伤
C. 磨损
D. 酸蚀症
E. 楔状缺损

正确答案：E。楔状缺损

解析：楔状缺损：多发生在牙唇面、颊面的牙颈部，尤其是尖牙和前磨牙。病因有机械摩擦、酸蚀和应力集中等。常伴有牙本质敏感和牙龈退缩等症状，重者也可出现牙髓暴露甚至引起牙折。掌握“牙体缺损病因及影响”知识点。